患者，男，15岁。正畸需要减数拔牙，术中误将右下尖牙认为第一前磨牙拔除。这种治疗方式的愈合方式中，不包括
A. 牙周膜愈合
B. 骨性愈合
C. 纤维性愈合
D. 骨结合
E. 骨性粘连

正确答案：D。骨结合

解析：本题考查牙槽外科。牙再植后的愈合有三种方式：牙周膜愈合（A对）、骨性粘连（BE对）和炎症性吸收（C对）。骨结合（D错，为本题正确答案）是牙种植的愈合方式。